引流物是由废橡皮手套剪成条状制成的引流方法是
A. 负压引流
B. 油纱条引流
C. 片状引流
D. 管状引流
E. 碘仿纱条引流

正确答案：C。片状引流

解析：片状引流：引流物由废橡皮手套剪成条状制成。主要用于口外创口少量渗液的引流，偶尔用于口腔内创口引流。其形状、长短和宽窄视手术性质、创口的深浅和引流液的多少而定。掌握“口外手术打结、缝合及外科引流”知识点。